因预防接种异常反应造成受种者死亡、严重残疾或者器官组织损伤的，应当给予
A. 一次性补偿
B. 分批次给予补偿
C. 属个人体质问题，无需补偿
D. 残疾者按原工资每月补偿
E. 需承担刑事责任

正确答案：A。一次性补偿